以下为种植全口义齿的特点，除了
A. 价格太贵
B. 制作过程复杂
C. 适用于牙槽嵴低平患者
D. 固位好
E. 咀嚼效率不佳

正确答案：E。咀嚼效率不佳

解析：本题考查种植全口义齿的特点。种植全口义齿的特点，除了咀嚼效率不佳（E错，为本题的正确答案）。种植全口义齿具有固位好（D对）、咀嚼效率佳、美观舒适、口内无异物感、避免基牙预备损伤组织的优点。缺点是价格太贵（A对），制作过程复杂（B对）。种植全口义齿适用于牙槽嵴低平（C对）以及颌骨缺损后用常规修复方法不能获得良好固位的患者。